以冰醋酸为溶剂可选择的方法为
A. 非水碱量法
B. 非水酸量法
C. 两者均可
D. 两者均不可

正确答案：A。非水碱量法

解析：本题考查非水溶液滴定法。非水碱量法（A对）以冰醋酸或冰醋酸-醋酐为溶剂，非水酸量法（BCD错）以乙二胺或二甲基甲酰胺为溶剂，不可混用。